下列药物中不能改善脑功能的是
A. 吡乙酰胺
B. 奥拉西坦
C. 氯噻酮
D. 盐酸茚氯嗪
E. 艾地苯醌

正确答案：C。氯噻酮

解析：本题考查氯噻酮。下列药物中不能改善脑功能的是氯噻酮（C错，为本题正确答案）。氯噻酮为利尿药，不用于改善脑功能。吡乙酰胺（A对）（吡拉西坦）和奥拉西坦（B对）为酰胺类中枢兴奋药。盐酸茚氯嗪（D对）具有复活大脑皮质自发脑波的作用，因而可改善记忆和脑震荡所致的行动障碍，以及延长缺氧环境下的生存时间。艾地苯醌（E对）为其他脑功能改善及抗记忆障碍药。